在亮菌甲素中加入助剂二甘醇所致的不良反应引发的危害是
A. 肝衰竭
B. 肾衰竭
C. 肺衰竭
D. 心脏瓣膜炎
E. 表皮松解综合征

正确答案：B。肾衰竭

解析：本题考查药物不良反应。在亮菌甲素中加入的二甘醇会在体内水解为草酸，具有强酸性，导致肾皮质损伤和肾衰竭（B对），严重者死亡。